女性38岁。已婚未育，经期腹痛4个月余，呈进行性加重。妇科检查：宫颈糜烂Ⅰ°，子宫正常大小，后倾，活动欠佳，附件增厚压痛，子宫骶韧带扪及触痛性结节，最可能的诊断
A. 盆腔结核
B. 宫颈癌
C. 慢性盆腔炎
D. 子宫内膜异位症
E. 子宫肌瘤

正确答案：D。子宫内膜异位症

解析：女性38岁，已婚未育（生育年龄女性不孕），经期腹痛4个月余，呈进行性加重（有继发性痛经且进行性加重），妇科检查子宫正常大小，后倾，活动欠佳，附件增厚压痛，子宫骶韧带扪及触痛性结节（扪及与子宫相连的囊性包块及盆腔内有触痛性结节），根据患者的生育史、临床表现和查体结果，最可能的诊断是子宫内膜异位症（D对）。盆腔结核（A错）可有不孕、月经失调、下腹坠痛和结核病的一般症状，但少有进行性加重的痛经，若附件受累，在子宫两侧可触及条索状的输卵管或输卵管与卵巢等粘连形成的大小不等及形状不规则的肿块，质硬、表面不平，呈结节状突起，或可触及钙化结节（P265-P266）。宫颈癌（B错）的典型表现为接触性出血（P306），与本例临床表现不符。慢性盆腔炎（C多）多有急性盆腔炎病史，常见症状为下腹痛、阴道分泌物增多，腹痛为持续性，活动或性交后加重（P261）。子宫肌瘤（E错）多表现为经量增多及经期延长，可有下腹坠胀、腰酸背痛，经期加重，肌瘤导致子宫增大超过3个月妊娠时可从腹部触及下腹包块，同时可有相应的压迫症状（P310-P311）。